艾滋病的传染源是
A. 猪
B. 蚊
C. 鼠
D. 人
E. 螨

正确答案：D。人